引起慢性肺心病最常见病因为
A. 阻塞性肺疾病
B. 肺栓塞
C. 支气管哮喘
D. 病毒性肺炎
E. 肺结核

正确答案：A。阻塞性肺疾病

解析：引起慢性肺心病最常见病因为慢性阻塞性肺疾病（COPD），约占80%～90%。掌握“慢性肺源性心脏病”知识点。